正确描述心脏收缩射血期的是
A. 主动脉瓣和肺动脉瓣开放
B. 主动脉瓣和肺动脉瓣关闭
C. 主动脉瓣开放，肺动脉瓣关闭
D. 主动脉瓣关闭，肺动脉瓣开放
E. 二尖瓣开放，主动脉瓣关闭

正确答案：A。主动脉瓣和肺动脉瓣开放

解析：主动脉瓣和肺动脉瓣开放（A对）时为心脏收缩射血期，血液可冲开主动脉瓣和肺动脉瓣进入血管中。